下列各项，不属亡阳证表现的是
A. 脉微欲绝
B. 唇舌淡白
C. 气息微弱
D. 汗出稀冷
E. 四肢温和

正确答案：E。四肢温和

解析：亡阳证多因阳虚进一步发展而致，也可因阴寒内盛阳气暴伤等原因所致，是阳气极度虚衰的状态，阳气虚衰不能温煦人体，失去固摄、推动的功能，可见冷汗、四肢厥冷、面色苍白、脉微欲绝等症状（ABCD错），而四肢温和为亡阴证的表现（E对）。